以下哪项不是可摘局部义齿具有的优点
A. 磨除牙体组织较少
B. 患者可以自行摘戴便于洗刷清洁
C. 对基牙要求不高，一般要求松动不超过Ⅰ°牙槽骨吸收在1/3以内
D. 可以修理、增补
E. 夜间摘除后可以让牙槽嵴得到适当休息

正确答案：C。对基牙要求不高，一般要求松动不超过Ⅰ°牙槽骨吸收在1/3以内

解析：本题考查可摘局部义齿具有的优点。可摘局部义齿需要靠卡环等固位体固定在基牙上才能发挥作用，所以对基牙要求很高，即松动不超过Ⅰ°牙槽骨吸收在1/3以内（C错，为本题正确答案）。可摘局部义齿与固定局部义齿相比，磨出牙体组织少（A对），患者能够自行摘戴，便于洗涮清洁（B对），所以夜间取下可以让被压迫的牙槽嵴得到适当休息（E对），且制作较简单，费用相对较低，可以修理和增补（D对）。